小儿癫痫风痫证发作的常见诱因是
A. 情志失调
B. 过度疲劳
C. 护养不当
D. 病后失调
E. 外感发热

正确答案：E。外感发热

解析：该题考查小儿癫痫风痫证的病因。风痫证易由外感发热诱发，抽搐明显，或伴有发热等症，多由急惊风反复发作变化而来，常见诱因是外感高热（E对）。